矿化程度最低的牙本质为
A. 管周牙本质
B. 管间牙本质
C. 球间牙本质
D. 修复性牙本质
E. 继发性牙本质

正确答案：C。球间牙本质

解析：本题考查矿化程度最低的牙本质。球间牙本质（C对）是在牙本质钙化不良时，钙质小球之间遗留的未被钙化的间质，矿化程度低，主要见于牙冠部近釉质牙本质界处。牙本质的矿化并不均匀。管周牙本质（A错）矿化程度高，含胶原纤维极少。管间牙本质（B错）矿化程度较管周牙本质低。修复性牙本质（DE错）由成牙本质细胞分泌牙本质基质矿化形成，继发性牙本质是牙本质的增龄性变化，矿化程度较球间牙本质高。